前列腺增生患者最重要的症状是
A. 尿潴留
B. 排尿困难
C. 尿失禁
D. 无痛性肉眼血尿
E. 尿频、尿急、尿痛

正确答案：B。排尿困难

解析：前列腺增生患者最重要的症状是排尿困难（B对），由于前列腺移行带增生，腺体突向后尿道，使前列腺部尿道伸长、弯曲、受压变窄，尿道阻力增加，引起排尿困难。尿潴留（A错）、尿失禁（C错）主要见于症状较重、梗阻明显的患者。无痛性肉眼血尿（D错）多见于泌尿系肿瘤，前列腺增生患者中较少见。尿频、尿急、尿痛（E错）多见于前列腺增生合并感染或结石的患者。最早：尿频 最重要：进行性排尿困难 最严重并发症：急性尿潴留